青霉素抗菌作用的机制是
A. 干扰菌细胞壁的合成
B. 干扰菌细胞蛋白质的合成
C. 破坏菌细胞膜通透性
D. 破坏菌细胞核酸的代谢
E. 干扰细菌细胞器的合成

正确答案：A。干扰菌细胞壁的合成

解析：细胞膜含有多种酶类，其中与肽聚糖合成有关的酶类（转肽酶或转糖基酶），也是青霉素作用的主要靶位，称其为青霉素结合蛋白。青霉素通过干扰这些酶的合成从而使细菌细胞膜合成障碍起到抗菌的作用。掌握“细菌的大小、形态和基本结构”知识点。